某患者夜间突发急腹症被送到某医院看急诊，初诊为急性胆囊炎。负责医生因自己年轻，怕担风险，未作任何处理，即让家属把患者送到20里外的中心医院就诊，延误了治疗时间，致使病人胆囊穿孔、中毒性休克。后虽经抢救挽救了生命，但医药费用去2万多元。对该医生的行为进行伦理评价时，应该主要考虑的是：是否做到了
A. 有利原则中的努力使患者受益的要求
B. 有利原则中的努力预防难以避免的伤害
C. 有利原则中的对利害全面权衡，选择受益最大、伤害最小的行动方案
D. 不伤害原则中的不应发生有意的伤害
E. 不伤害原则中的不给病人造成本可避免的各种损害

正确答案：C。有利原则中的对利害全面权衡，选择受益最大、伤害最小的行动方案